下列选项中，对精神病人歧视最为强烈的是
A. 文化程度低的女性
B. 文化程度高的女性
C. 文化程度低的男性
D. 文化程度高的男性
E. 文化素质低的女性

正确答案：C。文化程度低的男性

解析：本题考查对精神病人的歧视。调查显示，男性和文化程度较低者（C对ABDE错）对精神病人的歧视更为强烈。